年轻恒牙牙髓活力丧失最迟可到受伤后
A. 4个月
B. 6个月
C. 8个月
D. 10个月
E. 1年以上

正确答案：E。1年以上

解析：本题考查年轻恒牙外伤牙髓活力丧失的时间。牙震荡1～2周内应使患牙休息，必要时降低咬合以减轻患牙的（牙合）力负担，松动的患牙固定，受伤后1、3、6、12个月应定期复查，观察一年后若牙冠不变色，牙髓活力测试正常可不进行处理；若牙髓坏死迹象时，应进一步行根管治疗术，年轻恒牙，其活力可在一年后丧失（E对）。